关于弹性圆锥,不正确的是
A. 又称环甲膜
B. 为喉的滑膜关节结构
C. 为弹性纤维组成的膜状结构
D. 其上缘游离称为声韧带
E. 其前份增厚，称为环甲正中韧带，因其位置表浅，在急性喉梗阻时，可于此作喉腔穿剌

正确答案：B。为喉的滑膜关节结构

解析：弹性圆锥又称环甲膜（A对）。弹性圆锥为弹性纤维组成的膜状结构（C对B错,为本题正确答案）。弹性圆锥上缘游离称为声韧带（D对）。弹性圆锥前份增厚，称为环甲正中韧带，因其位置表浅，在急性喉梗阻时，可于此作喉腔穿剌（E对）。